对牙周保护性最强的方式是
A. 龈下边缘
B. 龈上边缘
C. 齐龈边缘
D. 刃状边缘
E. 肩台边缘

正确答案：B。龈上边缘

解析：本题考查修复体龈边缘设计应合乎牙周组织健康的要求。对牙周保护性最强的方式是龈上边缘（B对）。龈上边缘既不损伤龈组织，也便于检查和修改修复体的边缘，使它们更加密合，并能减少或消除对龈组织的刺激。龈下边缘（A错）容易积存食物，形成菌斑，以致破坏上皮附着，加深龈袋，产生牙周炎。齐龈边缘（C错）易积聚菌斑，导致继发龋和龈炎。刃状边缘（D错）的位置难以确定，一般用于倾斜牙。肩台边缘（E错）常用于烤瓷熔附金属冠唇侧边缘及全瓷冠边缘。